慢性肺心病患者，血气分析结果示：pH7.24，PaCO₂68mmHg，BE3.5mmol/L，血气结果应诊断为
A. 呼酸+代碱，失代偿
B. 呼碱+代碱，代偿
C. 呼酸+代酸，失代偿
D. 呼碱+代酸，代偿
E. 呼碱+代碱，失代偿

正确答案：A。呼酸+代碱，失代偿

解析：PH7.24（＜正常值7.35-7.45）处于失代偿，如果能代偿则PH会正常；PaCO₂68mmHg（＞正常值35-45mmHg）说明有CO₂潴留；BE为剩余碱，BE>+3为碱中毒。综上所述答案为呼酸+代碱，失代偿（A对）。